对大多数慢性疾病可实行第二级预防，这是指
A. 早发现，早诊断，早治疗的“三早”措施
B. 防止疾病恶化的措施
C. 针对致病因素的措施
D. 健康教育和健康促进的措施
E. 促进康复的措施

正确答案：A。早发现，早诊断，早治疗的“三早”措施